患者，男，46岁，因心绞痛伴房颤，给予维拉帕米治疗。维拉帕米的禁忌症是
A. 双侧肾动脉狭窄
B. 心力衰竭
C. 痛风
D. 冠心病
E. 哮喘

正确答案：B。心力衰竭

解析：本题考查药物的禁忌症。维拉帕米的禁忌症是心力衰竭（B对）。临床上常用的非二氢吡啶类CCB主要包括维拉帕米和地尔硫䓬两种药物，二至三度房室传导阻滞、心力衰竭患者禁用非二氢吡啶类CCB。双侧肾动脉狭窄（A错）是ACEI类药物的禁忌症。痛风（C错）是噻嗪类利尿剂的禁忌症。哮喘（E错）是非选择性β受体阻断剂的禁忌症。